普萘洛尔不能用于以下哪种疾病
A. 高血压伴支气管哮喘
B. 急性心肌梗死
C. 心力衰竭
D. 心绞痛
E. 心律失常

正确答案：A。高血压伴支气管哮喘

解析：β受体阻断药的禁忌症有严重心动过缓、严重左室功能减退、明显房室传导阻滞、低血压及支气管哮喘者（A错，为本题的正确答案）。β肾上腺素受体阻断药目前已被推荐作为治疗慢性心力衰竭常规用药（C对）。普萘洛尔、吲哚洛尔、噻吗洛尔及选择性B1受体阻断药阿替洛尔、美托洛尔和醋丁洛尔等均可用于心绞痛（D对）。尤其是用于对硝酸脂类不敏感或疗效差的稳定型心绞痛，可使发作次数减少，对伴有心律失常及高血压者尤为适用（E对）。β受体阻断药还能降低近期有心肌梗死者心绞痛的发病率和死亡率（B对）。